既涌吐痰涎，又截疟的药是
A. 升药
B. 常山
C. 瓜蒂
D. 白矾
E. 轻粉

正确答案：B。常山

解析：本题考查的是常山的功效。既涌吐痰涎，又截疟的药是常山（B对）。常山：【功效】涌吐痰饮，截疟。升药（A错）：【功效】拔毒去腐。瓜蒂（C错）：【功效】内服涌吐热痰、宿食；外用研末吹鼻，引去湿热。白矾（D错）：【功效】外用解毒杀虫，燥湿止痒；内服止血止泻，清热消痰。轻粉（E错）：【功效】外用杀虫、攻毒、敛疮；内服祛痰消积，逐水通便。